属于茜草科的是
A. 木通
B. 通草
C. 大血藤
D. 鸡血藤
E. 钩藤

正确答案：E。钩藤

解析：本题考查的是钩藤的来源。属于茜草科的是钩藤（E对）。钩藤：【来源】为茜草科植物钩藤、大叶钩藤、毛钩藤、华钩藤或无柄果钩藤的干燥带钩茎枝。木通（A错）：【来源】为本通科植物木通、三叶木通或白木通的干燥藤茎。通草（B错）：【来源】为五加科植物通脱木的干燥茎髓。大血藤（C错）：【来源】为木通科植物大血藤的干燥藤茎。鸡血藤（D错）：【来源】为豆科植物密花豆的干燥藤茎。